既可用于局部麻醉，又可用于抗心律失常的药物是
A. 胺碘酮
B. 普鲁卡因胺
C. 普萘洛尔
D. 利多卡因
E. 维拉帕米

正确答案：D。利多卡因

解析：本题考查利多卡因。利多卡因（D对）属于Ib类抗心律失常药，既可用于局部麻醉，又可用于抗心律失常。胺碘酮（A错）为延长动作电位时程药，属于广谱抗心律失常药。普鲁卡因胺（B错）属于Ⅰa类抗心律失常药，主要适用于危及生命的室性心律失常。普萘洛尔（C错）是β受体阻断剂，主要用于治疗室上性心律失常。维拉帕米（E错）为钙通道阻滞剂，用于心绞痛、室上性心律失常，原发性高血压。